调查某地60岁以上老年人白内障的患病率，适合选择的研究为
A. 现况研究
B. 病例对照研究
C. 队列研究
D. 实验流行病学
E. 理论流行病学

正确答案：A。现况研究

解析：本题考查现况研究。现况研究是通过对特定时点(或期间)和特定范围内人群中的疾病或健康状况和有关因素的分布状况的资料收集、描述，从而为进一步的研究提供病因线索。从观察分析指标来说，这种研究所得到的频率指标一般为特定时间内调查群体的患病率。因此，调查某地60岁以上老年人白内障的患病率，适合选择现况研究（A对BCDE错）。